之前被认定为囊肿，但是现今病理学改为肿瘤，病变多累及下颌磨牙及升支部，发生于上颌者，以第一磨牙后区多见的肿瘤为
A. 成釉细胞瘤
B. 牙瘤
C. 牙源性角化囊性瘤
D. 成釉细胞纤维瘤
E. 含牙囊肿

正确答案：C。牙源性角化囊性瘤

解析：2005年的WHO头颈部肿瘤分类中已将牙源性角化囊肿命名为牙源性角化囊性瘤，是一种良性、单囊或多囊、发生于颌骨内的牙源性肿瘤。临床上，男性较女性多见，病变多累及下颌磨牙及升支部，但发生于上颌者以第一磨牙后区多见。掌握“牙源性角化囊性瘤”知识点。